不经胃肠道给药的剂型是
A. 肛门栓
B. 糖浆剂
C. 舌下片
D. 颗粒剂
E. 胶囊剂

正确答案：C。舌下片

解析：本题考查的是中药制剂按给药途径与方法的分类。不经胃肠道给药的剂型是舌下片（C对）。中药制剂按剂型的给药途径和给药方法不同，可分为：（1）经口服给药的剂型：如汤剂、合剂、糖浆剂（B错）、颗粒剂（D错）、丸剂、片剂等。（2）经直肠给药的剂型：如灌肠剂、栓剂（A错）等。（3）经注射给药的剂型：如静脉、肌内、皮下、皮内及穴位注射剂。（4）呼吸道给药的剂型：如气雾剂、吸入剂等。（5）经皮肤给药的剂型：如洗剂、搽剂、涂膜剂、糊剂、软膏剂、硬膏剂、贴剂、贴膏剂等。（6）经黏膜给药的剂型：如滴眼剂、滴鼻剂、口腔膜剂、舌下片剂、含漱剂等。胶囊剂（E错）主要供口服用，也可外用于直肠、阴道等部位。